下列叙述中，哪一条不是队列研究的特点
A. 能直接估计因素与发病联系和相关程度，可计算发病率
B. 暴露人年的计算繁重
C. 结果可靠，多用于稀有之病
D. 队列研究检验假说能力强
E. 有助于了解疾病自然史

正确答案：C。结果可靠，多用于稀有之病

解析：本题考查队列研究的特点。队列研究的特点为：①直接估计因素与发病联系和相关程度，可计算发病率（A对）；②暴露人年的计算繁重（B对）；③队列研究检验病因假说能力较强（D对）；④队列研究有助于了解疾病自然史（E对）。队列研究不可用于罕见病的研究（C错，为本题正确答案）。